驾车时使用安全带属于促进健康行为中的
A. 基本健康行为
B. 日常促进健康行为
C. 保健行为
D. 避开环境危害行为
E. 预警行为

正确答案：E。预警行为